高血压预防中健康教育的对象是
A. 全人群
B. 学龄期儿童
C. 中老年人群
D. 高血压病高危人群
E. 高血压病人

正确答案：A。全人群

解析：高血压属于慢性病，所有慢性病的健康教育都按照“全人群策略和高危人群策略并重”进行。目前我国高血压的流行特点是发病率高、并发症发生率高、死亡率高及检出率低、服药率低、控制率低。因此高血压防治中健康教育的主要目的是在一般人群中（A对）预防高血压的发生，在高危人群中（D错）降低未来发病水平。